牙外伤脱落应将牙
A. 浸泡至热水中
B. 自来水冲刷牙根
C. 浸泡在75%酒精中
D. 将牙泡在新鲜的冷牛奶
E. 不作任何处理，迅速到医院就诊

正确答案：D。将牙泡在新鲜的冷牛奶

解析：预防牙外伤：学龄儿童在参加体育活动和游戏时易发生牙外伤，受伤后出现牙龈出血，牙折断、松动、移位时应立即到医院就诊。如果整个牙脱落时，要用凉开水或自来水冲洗掉牙表面的污物，不要刷、刮牙根部，将冲洗干净的牙放回到牙槽窝中，或将牙泡在新鲜的冷牛奶、生理盐水或含在口腔内舌下，迅速到医院就诊。掌握“学龄儿童口腔保健”知识点。